菌斑细菌的直接致病作用主要表现在
A. 入侵宿主组织
B. 体内繁殖
C. 抑制或躲避宿主的防御机能
D. 损害宿主的牙周组织
E. 以上都是

正确答案：E。以上都是

解析：牙周微生物的致病机制包括牙周微生物在牙周病发病中的作用和引发宿主免疫反应在牙周病发病中的作用两个方面。其中牙周微生物在牙周病发病中的作用又分为以下几项：①牙周定植、存活和繁殖；②入侵宿主组织；③抑制或逃避宿主防御机能；④损害宿主牙周组织。掌握“牙周疾病促进因素”知识点。